抑制胃壁细胞的H⁺泵的药物是
A. 碳酸氢钠
B. 西咪替丁
C. 奥美拉唑
D. 米索前列醇
E. 胃蛋白酶

正确答案：C。奥美拉唑

解析：本题考查奥美拉唑。奥美拉唑（C对）是质子泵抑制剂，能够特异性抑制胃黏膜壁细胞上的H⁺，K⁺-ATP酶；碳酸氢钠（A错）是调节酸碱平衡的药，呈碱性，可直接增加人体的碱储备；西咪替丁（B错）是组胺H₂受体阻断剂，可阻断组胺H₂受体，可逆性竞争壁细胞基底膜上的H₂受体，显著抑制胃酸分泌；米索前列醇（D错）可以在抑制胃酸分泌同时保护胃黏膜不受侵害；胃蛋白酶（E错）是助消化药，在弱酸性环境中消化力最强，用于消化不良，食欲减退等。